患者，男，48岁。两乳内发现疼痛性肿物1周。检查：肿物大小约3cm×3cm×1cm，质地中等，有压痛，位于乳晕中央，界限清楚，可移动。应首先考虑的是
A. 乳癖
B. 乳痨
C. 乳疬
D. 乳岩
E. 乳腺增生病

正确答案：C。乳疬

解析：题干中肿块质地中等，有压痛，位于乳晕中央，界限清楚，可移动，可诊断为乳疬（C对）。乳癖可见单侧或双侧乳房疼痛并出现肿块，乳痛和肿块与月经周期及情志变化密切相关，好发于25至45的中青年妇女。（A错）。乳痨是乳房部的慢性化脓性疾病。因其病变后期常有虚痨表现，故名乳痨，溃后脓液稀薄如痰（B错）。乳岩可见肿块坚硬，推之不移，与题干不符（D错）。乳腺增生病可见乳房肿块，经前肿痛加重，经后减轻，亦不符（E错）。